感冒清热颗粒除疏风散寒外，又能
A. 解表清热
B. 解热止痛
C. 清热解毒
D. 清宣肺热
E. 宣肺止咳

正确答案：A。解表清热

解析：本题考查的是感冒清热颗粒的功能。感冒清热颗粒除疏风散寒外，又能解表清热（A对）。感冒清热颗粒：【功能】疏风散寒，解表清热。正柴胡饮颗粒：【功能】发散风寒，解热止痛（B错）。银翘解毒丸：【功能】疏风解表，清热解毒（C错）。清宣止咳颗粒：【功能】疏风清热，宣肺止咳（DE错）。